结石的致病特点是
A. 扰乱神明，影响心神
B. 形成肿块，固定不移
C. 阻滞气机，损伤脉络
D. 致病广泛，变化多端
E. 多发疼痛，刺痛不移

正确答案：C。阻滞气机，损伤脉络

解析：阻滞气机，损伤脉络是结石的治病特点（C对）。扰乱神明，影响心神为热邪的治病特点（A错）。形成肿块，固定不移为气滞血瘀的表现（B错）。致病广泛，变化多端是痰饮的治病特点（D错）。多发疼痛，刺痛不移是淤血的治病特点（E错）。